不属于延髓背外侧综合征临床表现的是
A. 眩晕，眼球震颤
B. 饮水呛咳，吞咽困难
C. 交叉性感觉障碍
D. 锥体束征阳性
E. 同侧肢体共济失调

正确答案：D。锥体束征阳性

解析：锥体束征阳性（D错，为本题正确答案）为上运动神经元损害出现的原始反射，而延髓背外侧综合征并不累及锥体束。延髓背外侧综合征，指小脑后下动脉闭塞过血供不足引起的延髓背侧梗死引起的临床综合征。主要症状包括：①病侧面部和对侧躯干和肢体（不包括面部）痛、温觉障碍，即交叉性感觉障碍（C对）。②病侧软腭麻痹、构音及吞咽障碍，咽反射减弱或丧失，导致饮水呛咳（B对）。③眩晕、恶心、呕吐及眼球震颤（A对）；④病灶侧不全型Horner征⑤同侧肢体和躯干共济失调（E对）。